代谢性酸中毒主要是由于体内
A. PaCO₂升高
B. HCO₃⁻増多
C. PaCO₂降低
D. 阴离子间隙减少
E. HCO₃⁻减少

正确答案：E。HCO₃⁻减少

解析：代谢性酸中毒主要是由于体内HCO₃⁻减少（E对）。HCO₃⁻増多（B错）引起代谢性碱中毒，PaCO₂升高（A错）引起呼吸性酸中毒，PaCO₂降低（C错）引起呼吸性碱中毒，阴离子间隙（D错）指血浆中未测定的阴离子与未测定的阳离子的差值，它可鉴别不同类型的代谢性酸中毒。增高见于糖尿病酮症酸中毒、尿毒症等；正常见于高血氯性代谢性酸中毒。